检查溴化钠中的砷盐，规定含砷量不得过0.0004%，取标准砷溶液2.0ml（每1m1相当于1㎍的As）制备标准砷斑，应取供试品
A. 0.1g
B. 0.2g
C. 0.5g
D. 1.0g
E. 2.0g

正确答案：C。0.5g